外科辨证中，要首辨阴阳，下列属阳证的是
A. 局部紫暗或皮色不变
B. 骨蒸潮热，疮形平坦下陷
C. 隐痛，脓液稀薄或纯血水
D. 肿块软硬适度，溃后渐消
E. 肿胀范围不局限，根脚散漫

正确答案：D。肿块软硬适度，溃后渐消

解析：肿块软硬适度，溃后渐消的属阳（D对）。皮肤颜色紫暗或皮色不变的属阴（A错）。肿胀形势平塌下陷的属阴（B错）。不痛、隐痛、酸痛或抽痛的属阴。脓液稀薄或纯血水的属阴（C错）。肿胀范围不局限、根脚散漫的属阴（E错）。